女，7天，早产儿。两天前出现全身皮肤粘膜发黄，并逐渐加重，测定血清胆红素14mg/dl。该患儿最有可能的诊断是
A. 新生儿生理性黄疸
B. 新生儿寒冷损伤综合症
C. 新生儿败血症
D. 新生儿窒息
E. 新生儿缺氧缺血性脑病

正确答案：A。新生儿生理性黄疸

解析：约80%的早产儿可出现生理性黄疸，其特点为：1.一般情况良好，2.早产儿生后3～5天出现黄疸，5～7天达高峰，7～9天消退，最长可延迟到3～4周（A对），3.每日血清胆红素升高＜85μmol/L（5mg/dl）。